有关医院感染的概念错误的是
A. 在医院内获得的感染
B. 出院之后的感染有可能是医院感染
C. 入院时处于潜伏期的感染一定不是医院感染
D. 与上次住院有关的感染是医院感染
E. 婴幼儿经胎盘获得的感染属医院感染

正确答案：E。婴幼儿经胎盘获得的感染属医院感染

解析：医院感染是指住院患者在医院内获得的感染（A对），也包括在医院内获得感染而出院后发病的感染，因此出院之后的感染有可能是医院感染（B对），与上次住院有关（D对）也属于医院感染，而入院前已开始或入院时就已经存在的感染不属于医院感染（C对）。医院工作人员在医院内获得的感染也属于医院感染。婴幼儿经胎盘获得的感染（E错，为本题正确答案）如不是经在医院因素获得，不属于医院感染。